男，65岁。间断咳嗽20年，活动后气短3年。昨日晨练时突发胸痛、呼吸困难。查体：左侧胸廓略饱满，左肺呼吸音明显减弱，心率110次/分，可闻早搏4次/分。该患者最可能的诊断是
A. 慢性阻塞性肺气肿
B. 左肺肺大泡
C. 自发性气胸
D. 肺栓塞
E. 支气管哮喘

正确答案：C。自发性气胸

解析：老年患者，间断咳嗽20年，活动后气短3年（为慢阻肺的典型症状），考虑有慢性阻塞性肺疾病。在慢性阻塞性肺疾病基础上如有突然加重的呼吸困难，胸廓略饱满，听诊呼吸音减低，应首先考虑自发性气胸（C对）。慢性阻塞性肺气肿（A错）发生时，通气和换气功能障碍常引起缺氧和二氧化碳潴留，以不同程度的低氧血症和高碳酸血症为主要临床表现，最终出现呼吸功能衰竭，不会出现突然加重的呼吸困难。支气管哮喘（P29）（E错）典型的症状为发作性伴有哮鸣音的呼气性呼吸困难，发作时的体征为双肺广泛的哮鸣音，呼气音延长。肺大泡（B错）一般继发于小支气管的炎症病变，合并慢阻肺的肺大泡多有明显胸闷、气短等症状，无突发呼吸困难表现。肺栓塞（P100）（D错）临床表现多样，可以为不明原因的呼吸困难及气促，胸痛，晕厥，烦躁不安、惊恐或濒死感，咯血、咳嗽心悸等，体征主要为呼吸急促，心动过速，血压变化等，但无胸廓饱满体征。